属病理生理诊断的是
A. 二尖瓣狭窄
B. 风湿性心脏病
C. 心房颤动
D. 心慌气短
E. 下肢浮肿

正确答案：C。心房颤动

解析：病理生理诊断反映疾病引起的机体功能或生理改变，属病理生理诊断的是心房颤动（C对）。病理形态诊断指对疾病的病变部位、范围、性质以及组织结构的改变作出的诊断。属病理解剖的诊断是二尖瓣狭窄（A错）。风湿性心脏病属于病因诊断（B错）。心慌气短、下肢浮肿属于症状（DE错）。